光固封闭剂涂布后用可见光源照射，照射距离约离牙尖
A. 1mm
B. 2mm
C. 3mm
D. 4mm
E. 1cm

正确答案：A。1mm

解析：自凝封闭剂涂布后1～2分钟即可自行固化。光固封闭剂涂布后，立即用可见光源照射。照射距离约离牙尖1mm，照射时间要根据采用的产品类型与可见光源性能决定，一般约为20～40秒。照射的部位要大于封闭剂涂布的部位。掌握“窝沟封闭术”知识点。